甲是药品零售连锁企业，下辖300余家直营门店，经营类别为处方药、甲类非处方药、乙类非处方药；经营范围为中药饮片、化学药、生物制品、中成药。甲有自建网站，2011年取得《互联网药品信息服务资格证书》，2012年取得《互联网药品交易服务资格证书》，获准通过自建网站开展网络药品销售活动。2017年1月和9月，国务院两次发布决定取消了部分行政许可，包括第三方网络药品交易平台在内的互联网药品交易服务企业审批被取消。甲在此后的下列经营行为中符合药品经营管理规定的是
A. 通过自建网站销售经营范围内的所有处方药和非处方药
B. 通过自建网站将非处方药销售给某个体诊所
C. 通过自建网站向个人消费者提供用药咨询服务
D. 通过自建网站将非处方药销售给某药品零售企业

正确答案：C。通过自建网站向个人消费者提供用药咨询服务

解析：本题考查的是药品零售的经营行为管理要求。甲是药品零售连锁企业，下辖300余家直营门店，经营类别为处方药、甲类非处方药、乙类非处方药；经营范围为中药饮片、化学药、生物制品、中成药。甲有自建网站，2011年取得《互联网药品信息服务资格证书》，2012年取得《互联网药品交易服务资格证书》，获准通过自建网站开展网络药品销售活动。2017年1月和9月，国务院两次发布决定取消了部分行政许可，包括第三方网络药品交易平台在内的互联网药品交易服务企业审批被取消。甲在此后的下列经营行为中符合药品经营管理规定的是通过自建网站向个人消费者提供用药咨询服务（C对）。药品零售企业可以配置必要的药学服务设施设备，为个人消费者提供健康便民服务，可通过专用电话、互联网等方式为个人消费者提供用药咨询、售后投诉等药学服务。通过自建网站销售经营范围内的所有处方药和非处方药（A错）、通过自建网站将非处方药销售给某个体诊所（B错）与通过自建网站将非处方药销售给某药品零售企业（D错）属于第三方网络药品交易，故不符合符合药品经营管理规定。